墨旱莲除滋阴益肾外，又能
A. 退热除蒸
B. 凉血止血
C. 软坚散结
D. 明目，润肠
E. 祛痰，益气

正确答案：B。凉血止血

解析：本题考查的是墨旱莲的功效。墨旱莲除滋阴益肾外，又能凉血止血（B对）。墨旱莲：【功效】滋阴益肾，凉血止血。鳖甲：【功效】滋阴潜阳，退热除蒸（A错），软坚散结（C错）。决明子：【功效】清肝明目，润肠通便（D错）。南沙参：【功效】清肺养阴，祛痰，益气（E错）。